肺通气的原动力是
A. 肺的弹性回缩力
B. 吸气肌的主动收缩
C. 呼吸肌的舒缩活动
D. 肺的主动舒缩
E. 大气压与肺内压之差

正确答案：C。呼吸肌的舒缩活动

解析：肺通气是气体流动的进出肺的过程，要实现肺通气，必须在肺泡与外界环境之间存在一定压力差。在一定的海拔高度，大气压是相对恒定的，因此肺泡与外界环境之间的压力差是由肺泡内的压力（肺内压）决定的。肺内压的高低取决于肺的扩张和缩小，但肺自身并不具有主动舒缩能力（D错），其扩张和缩小依赖于呼吸肌的收缩和舒张引起的胸廓运动。因此，肺通气的原动力是呼吸肌的舒缩活动（C对AB错）；肺通气的直接动力是大气压与肺内压之差（E错）。